以下药物的鉴别反应是：盐酸利多卡因
A. 在酸性条件下，和亚硝酸钠与β-萘酚反应，显橙红色
B. 在碳酸钠试液中，与硫酸铜反应，生成蓝紫色配合物
C. 与硝酸反应，显黄色
D. 加入三氯化铁试液，显紫红色
E. 加入三氯化铁试液，生成色沉淀

正确答案：B。在碳酸钠试液中，与硫酸铜反应，生成蓝紫色配合物

解析：本题考查盐酸利多卡因的鉴别反应。盐酸利多卡因分子结构中具有芳酰胺和脂肪胺的结构，可与金属离子发生反应。其鉴别反应为：取本品0.2g，加水20ml溶解后，取溶液2ml，加硫酸铜试液0.2ml与碳酸钠试液1ml，即显蓝紫色（B对）；加三氯甲烷2ml，振摇后放置，三氯甲烷层显黄色。